肾炎时，毛细血管管壁增厚呈车轨状或分层状见于
A. 急性弥漫性增生性肾小球肾炎
B. 弥漫性系膜增生性肾小球肾炎
C. 弥漫性膜性增生性肾小球肾炎
D. 弥漫性硬化性肾小球肾炎
E. 弥漫性新月体性肾小球肾炎

正确答案：C。弥漫性膜性增生性肾小球肾炎

解析：毛细血管壁增厚呈车轨状或分层状见于弥漫性膜性增生性肾小球肾炎（C对），其组织学特点是肾小球基膜增厚、系膜细胞增生和系膜基质增多，增生的系膜细胞突起插入毛细血管袢中，形成车轨状。急性弥漫性增生性肾小球肾炎（A错）的组织学特点为内皮细胞和系膜细胞增生（P265）。弥漫性系膜增生性肾小球肾炎（B错）的组织学特点为系膜细胞和系膜基质增多（P272）。弥漫性硬化性肾小球肾炎（D错）即慢性肾小球肾炎（P273），是不同类型肾小球是肾炎发展的终末阶段，其组织徐特点是大量肾小球发生玻璃样变和硬化。弥漫性新月体性肾小球肾炎（E错）的组织学特点为新月体形成（P267）。